下列属于人体必需微量元素的是
A. 铝
B. 钴
C. 镁
D. 锰
E. 钾

正确答案：B。钴